下列方剂中生地和熟地同用的是
A. 百合固金汤
B. 镇肝熄风汤
C. 羚角钩藤汤
D. 川芎茶调撒
E. 大定风珠

正确答案：A。百合固金汤

解析：百合固金汤方含生地、熟地、当归身、白芍、甘草、桔梗、玄参、贝母、麦冬、百合，以滋润肺肾，止咳化痰。其中，生地、熟地（A对）为君药，滋肾阴；百合、麦冬，养肺阴，玄参咸寒，助二地滋肾、降虚火，共为臣药，君臣相伍，滋润肺肾，金水并补；佐以桔梗、贝母，化痰止咳。镇肝熄风汤含有怀牛膝、生赭石、生龙骨、生牡蛎、生龟板、生杭芍、玄参、天冬、川楝子、生麦芽、茵陈、甘草（B错）。羚角钩藤汤含有羚角、桑叶、川贝、鲜生地、钩藤、菊花、茯神木、生白芍、生甘草、竹茹（C错）。川芎茶调散含有川芎、荆芥、白芷、羌活、甘草、细辛、防风、薄荷叶（D错）。大定风珠含有生白芍、阿胶、生龟板、干地黄（即生地）、麻仁、五味子、生牡蛎、麦冬、炙甘草、鸡子黄、鳖甲（E错）。百合固金二地黄，玄参贝母桔甘藏，麦冬芍药当归配，喘咳痰血肺家伤。